属五行相乘传变的是
A. 肝病及脾
B. 脾病及心
C. 肝病及心
D. 肝病及肾

正确答案：A。肝病及脾

解析：肝在五行之中，属于木；脾在五行之中，属于土，木克土。肝病及脾，为木克土太过，属相乘传变（A对）。心在五行之中，属于火，火生土，脾病及心为子病犯母（B错）。木生火，肝病及心是母病及子（C错）。肾在五行之中，属水，水生木，肝病及肾，为子病犯母（D错）。